作为EB病毒受体的CD分子是
A. CD4
B. CD28
C. CD19
D. CD21
E. CD40

正确答案：D。CD21